小儿结核病最常见的类型是
A. 结核性胸膜炎
B. 粟粒性肺结核
C. 结核性腹膜炎
D. 原发型肺结核
E. 结核性脑膜炎

正确答案：D。原发型肺结核

解析：结核病分为①原发型肺结核（D对）：包括原发综合征和支气管淋巴结核，为儿童最常见的类型，无症状或症状轻。②血行播散型肺结核：包括急性粟粒型肺结核（B错）和亚急性、慢性播散型肺结核，多见于营养不良、患传染病和长期使用免疫抑制剂的小儿，并多同时伴有原发型肺结核。③继发型肺结核：包括浸润性肺结核、空洞性肺结核、结核球、干酪性肺炎、纤维空洞性肺结核，多由内源性复发或外源性再感染而致，常见于成人。④结核性胸膜炎（A错）多由肺门淋巴结核的细菌经淋巴管逆流至胸膜、邻近胸膜的肺结核病灶破溃，结核杆菌或结核感染的产物直接进入胸膜腔而致，多引起渗出性胸水。⑤其他肺外结核，包括结核性脑膜炎（E错）（是小儿结核病最严重的类型）、结核性腹膜炎（C错）（以中青年多见）、骨结核等。